八纲辨证中，寒热证候主要辨析的是
A. 疾病部位
B. 疾病原因
C. 疾病性质
D. 病势趋向
E. 疾病传变

正确答案：C。疾病性质

解析：本题考查的是寒证、热证。八纲辨证中，寒热证候主要辨析的是疾病性质（C对）。八纲辨证是各种辨证的总纲。八纲，即指阴、阳、表、里、寒、热、虚、实八类证候。八纲辨证就是把千变万化的病证，归纳为表与里、寒与热、虚与实、阴与阳四对纲领性证候，用以指导临床治疗。1.表证、里证：表里辨证是辨别病变部位（A错）和病势趋向（D错）的一种辨证方法。一般地说，病在皮毛、肌腠，部位浅在者属表证；病在脏腑、血脉、骨髓，部位深在者属里证。2.寒证、热证：寒热，是辨析疾病性质的两个纲领。寒热也是阴阳偏盛偏衰的具体表现。一般地说，寒证是机体阳气不足或感受寒邪所表现的证候，热证是机体阳气偏盛或感受热邪所表现的证候。3.虚证、实证：虚实辨证，是分析辨别邪正盛衰的两个纲领。虚证，指人体正气不足所表现的证候。实证，是由邪气过盛所反映出来的一类证候。4.阴证、阳证：阴阳是八纲辨证的总纲，用以统括其余的六个方面。阴阳可以归纳表、里、寒、热、虚、实的六种证候。表、热、实证属阳证。里、寒、虚证属阴证。疾病发生、发展和变化的根本原因（B错）在于阴阳失调。任何疾病都可用阴或阳来加以概括辨析而运用于疾病的诊断辨证之中。传变（E错）是指某脏有病可以传至他脏，他脏疾病也可以传至本脏，这种病变上的相互影响。五行学说在疾病诊断中应用于阐释疾病转变。